预防HBeAg阳性母亲所生的新生儿HBV感染最有效的措施是
A. 丙种球蛋白
B. 高效价乙肝免疫球蛋白
C. 乙肝疫苗
D. 高效价乙肝免疫球蛋白加乙肝疫苗
E. 乙肝疫苗加丙种球蛋白

正确答案：D。高效价乙肝免疫球蛋白加乙肝疫苗

解析：HBV慢性感染母亲的新生儿在出生后24小时内尽早（最好不超过12小时）注射乙型肝炎免疫球蛋白（HBIG），剂量≥100IU，同时在不同部位接种10μg重组酵母乙型肝炎疫苗，在1个月和6个月时分别接种第2和第3针乙型肝炎疫苗（D对）。